关于t界值表错误的一项是
A. 双侧t₀.₁₀，₂₀=单侧t₀.₀₅，₂₀
B. 单侧t₀.₀₅，₂₀＜双侧t₀.₀₅，₂₀
C. 双侧t₀.₀₅，₂₀＜双侧t₀.₀₁，₂₀
D. 单侧t₀.₀₅，₂₀＞单侧t₀.₀₅，₁₅
E. 单侧t₀.₀₅，₂₀＜单侧t₀.₀₅，₁₅

正确答案：D。单侧t₀.₀₅，₂₀＞单侧t₀.₀₅，₁₅